以下哪几项与艾司唑仑相符合
A. 又名舒乐安定
B. 本品分子中有4个环
C. 本品的水解产物可发生重氮化偶合反应
D. 7位有氯取代
E. 本品为抗焦虑药

正确答案：A、B、D、E。又名舒乐安定；本品分子中有4个环；7位有氯取代；本品为抗焦虑药